材料六，某药品零售企业（单体门店）具有与经营药品相适应的营业场所、设施设备和卫生环境，建有企业门户网站。为拓展业务，向所在地省级药品监督管理部门申请办理向个人消费者提供互联网药品交易机构资格证书。该药品监督管理部门收到材料，进行形式审查后，告知其不予受理。鉴定上述材料中企业已经具备主体资格，现欲从事向个人消费者提供互联网药品交易服务，该企业应具备的条件，错误的是
A. 应具备药学或者相关专业本科学历的专职人员负责网上实时咨询
B. 应具备健全的网络交易与安全保障措施以及完整的管理制度
C. 应具备完整保存交易记录的能力、设施和设备
D. 应具备网上咨询、网上查询、生成订单、电子合同等基本交易服务功能

正确答案：A。应具备药学或者相关专业本科学历的专职人员负责网上实时咨询

解析：本题考查《互联网药品交易服务审批暂行规定》。材料六，某药品零售企业（单体门店）具有与经营药品相适应的营业场所、设施设备和卫生环境，建有企业门户网站。为拓展业务，向所在地省级药品监督管理部门申请办理向个人消费者提供互联网药品交易机构资格证书。该药品监督管理部门收到材料，进行形式审查后，告知其不予受理。鉴定上述材料中企业已经具备主体资格，现欲从事向个人消费者提供互联网药品交易服务，该企业应具备的条件，错误的是应具备药学或者相关专业本科学历的专职人员负责网上实时咨询（A错，为本题正确答案）。《互联网药品交易服务审批暂行规定》第九条：向个人消费者提供互联网药品交易服务的企业，应当具备以下条件：（一）依法设立的药品连锁零售企业；（二）提供互联网药品交易服务的网站已获得从事互联网药品信息服务的资格；（三）具有健全的网络与交易安全保障措施以及完整的管理制度（B对）；（四）具有完整保存交易记录的能力、设施和设备（C对）；（五）具备网上咨询、网上查询、生成订单、电子合同等基本交易服务功能（D对）；（六）对上网交易的品种有完整的管理制度与措施；（七）具有与上网交易的品种相适应的药品配送系统；（八）具有执业药师负责网上实时咨询，并有保存完整咨询内容的设施、设备及相关管理制度；（九）从事医疗器械交易服务，应当配备拥有医疗器械相关专业学历、熟悉医疗器械相关法规的专职专业人员。